当基牙牙周应力分布最均匀时，（牙合）支托凹底与基牙长轴的夹角为
A. 5°
B. 10°
C. 15°
D. 20°
E. 25°

正确答案：D。20°

解析：本题考查（牙合）支托与基牙关系。当基牙牙周应力分布最均匀时，（牙合）支托凹底与基牙长轴的夹角为20°（D对）。生物力学研究证明支托凹底应与基牙长轴成正20°角时，基牙牙周应力分布最均匀，即支托所承受的作用力顺基牙长轴方向传递，不易使基牙倾斜移位。